骨折的专有体征是
A. 局部疼痛
B. 局部肿胀
C. 局部瘀斑
D. 反常活动
E. 功能障碍

正确答案：D。反常活动

解析：骨折的专有体征包括畸形、反常活动（D对）及骨擦音或骨擦感。局部疼痛（A错）、局部肿胀（B错）、局部瘀斑（C错）和功能障碍（E错）都属于骨折的一般表现，这些症状还可见于很多疾病，并不是骨折所专有。